急性毒性试验的目的是
A. 阐明外来化合物毒性作用的中毒机制
B. 确定LOAEL和NOAEL
C. 评价外来化合物对机体毒性剂量-反应关系，并根据LD₅₀进行毒性分级
D. 为致癌试验的剂量设计提供依据
E. 以上都是

正确答案：C。评价外来化合物对机体毒性剂量-反应关系，并根据LD₅₀进行毒性分级